大动脉弹性降低
A. 使收缩压与舒张压都升高
B. 使收缩压与舒张压都降低
C. 使收缩压升高，舒张压降低
D. 使收缩压升高，舒张压无影响
E. 只使舒张压升高，收缩压无影响

正确答案：C。使收缩压升高，舒张压降低

解析：大动脉的弹性储器作用主要使动脉间断的射血变成血管系统中连续的血流，从而使心动周期中动脉血压的波动幅度减小。当大动脉弹性降低时，对血压的缓冲作用减弱，因而收缩压增高而舒张压降低（C对DE错），脉压差增大。收缩压与舒张压都升高（A错）可见于心率增快和外周血管阻力增高（P124）。心率收缩压与舒张压都降低（B错）见于心率减慢和外周血管阻力减小（P124）。